主要用作消毒剂或杀菌剂的表面活性剂是
A. 十二烷基硫酸钠
B. 聚山梨酯
C. 卵磷脂
D. 泊洛沙姆
E. 苯扎氯铵

正确答案：E。苯扎氯铵